采用化学消毒剂消毒时，甲醛主要适用的是
A. 刀片
B. 剪刀
C. 纱布
D. 被服
E. 导尿管

正确答案：E。导尿管

解析：甲醛（福尔马林）：其中的醛基能使微生物的蛋白质变性，使其酶活性消失，致使微生物死亡。临床上常用10%甲醛水溶液，用于膀胱镜、胶丝质导尿管等、浸泡30分钟即可（E对）。75%乙醇：能使菌体的蛋白质变性而达到灭菌的目的。用于锐利器械如针、刀、剪等（AB错）。胶、丝线类物品应于水煮沸后放入，煮沸15分钟即可取出，避免过久煮沸而影响质量（CD错）。